男性，2岁。1个月来食欲减退，消瘦伴乏力，低热、盗汗、干咳2个月，易怒。体检：颈部可见数个肿大淋巴结，肝肋下1.5cm，结核菌素试验（++）。患儿最可能的诊断
A. 原发性肺结核
B. 支气管肺炎
C. 支气管淋巴结核
D. 浸润性肺结核
E. 颈部淋巴结核+支气管淋巴结核

正确答案：A。原发性肺结核

解析：患儿食欲减退，消瘦乏力，低热盗汗，为结核病的全身中毒症状。患儿干咳2个月，结核菌素试验阳性，应诊断为肺结核。由于小儿以原发型肺结核多见，成人以浸润型肺结核多见（D错），故本例应诊断为原发性肺结核（A对）。支气管肺炎无低热盗汗等结核中毒症状（B错）。支气管淋巴结核为原发型肺结核的表现形式之一，原发性肺结核包括原发综合征和支气管淋巴结核（CE错）。本例不能仅凭“颈部数个肿大淋巴结”而误选择答案E。